以下关于前牙3/4冠切斜面的要求哪项是不正确的
A. 与牙长轴呈90°角
B. 预备出0.7mm以上间隙
C. 尖牙要形成近远中两个斜面
D. 上前牙由唇侧斜向舌侧
E. 下前牙由舌侧斜向唇侧

正确答案：A。与牙长轴呈90°角

解析：本题考查前牙3/4冠切斜面的要求。关于前牙3/4冠切斜面的要求不正确的是与牙长轴呈90°角（A错，为本题正确答案）。前牙3/4冠切端要预备出0.7mm以上的间隙（B对），以保证修复体的厚度和强度。切斜面要与牙长轴呈45°，以保证不会显露金属影响美观。上前牙由唇侧斜向舌侧（D对）、下前牙由舌侧斜向唇侧（E对）的设计也是这个目的。尖牙要形成近远中两个斜面（C对）可以增加粘结固位的面积提高固位，也可以保留尖牙的牙尖形态利于美观。